下列关于枕前位分娩机制，判定产程进展的重要标志是
A. 衔接
B. 下降
C. 内旋转
D. 俯屈
E. 仰伸

正确答案：B。下降

解析：胎儿沿骨盆轴前进的动作称为下降，是胎儿娩出的首要条件。下降动作贯穿于分娩全过程，与其他动作相伴随。下降动作呈间歇性，宫缩时胎头下降，间歇时胎头又稍回缩。促使先露下降的因素有：宫缩时通过羊水传导，压力经胎轴传至胎头；宫缩时有宫底直接压迫胎臀；宫缩时胎体伸直伸长，腹肌收缩使腹压增加。初产妇胎头下降速度因宫口扩张缓慢和软组织阻力大较经产妇慢。临床上将胎头下降程度作为判断产程进展的重要标志，尤其在活跃晚期和第二产程（B对）。